心房颤动时f波的频率为
A. 350次～600次/分
B. ＜150次/分
C. 150次～200次/分
D. ＞600次/分
E. 250次～300次/分

正确答案：A。350次～600次/分

解析：心房颤动是一种常见的心律失常，是指规则有序的心房电活动丧失，代之以快速无序的颤动波，是严重的心房电活动紊乱。其心电图主要表现为①P波消失，代之以小而不规则的基线波动，形态与振幅均变化不定，称为f波；频率约350～600次/分（A对BCD错）；②心室率极不规则③QRS波群形态通常正常，当心室率过快，发生室内差异性传导，QRS波群增宽变形。阵发性室上性心动过速的心室率约为150～250次/分，室速的心室率为100～250次/分，室扑的频率为150～300次/分。典型的房扑的频率为250次～300次/分（E错）。